诊断反流性食管炎最准确的检查方法是
A. 食管24小时pH监测
B. 食管X线钡剂造影
C. 食管测压
D. 胃镜
E. 质子泵诊断性治疗

正确答案：D。胃镜

解析：诊断反流性食管炎（RE）最准确的检查方法是胃镜（D对），并能判断RE的严重程度和有无并发症，结合活检可与其他原因引起的食管炎和其他食管病变（如食管癌等）相鉴别。正常食管黏膜为复层鳞状上皮，胃镜下呈均匀粉红色，当其被化生的柱状上皮替代后呈橘红色，多位于胃食管连接处的齿状线近端，当环形、舌形或岛状病变≥1cm时，应考虑为Barrett食管。食管24小时pH监测（A错）可检测食管是否存在过度酸、碱反流。食管X线钡剂造影（B错）对诊断GERD的敏感性不高。食管测压（C错）可了解食管动力状态，用于抗反流手术术前评估。质子泵诊断性治疗（E错）不能明确是RE，因为PPI对好几种疾病都有效。